生命质量测量中相对稳定的指标是
A. 一般性感觉
B. 角色功能
C. 情绪反应
D. 认知功能
E. 活动受限

正确答案：D。认知功能